下列哪项符合漏出液的特点
A. 外观呈血性
B. 比重>1.018
C. 能自凝
D. 白细胞计数>0.55×10⁹/L
E. 无病原菌

正确答案：E。无病原菌

解析：漏出液为非炎症积液，其特点为：①外观呈淡黄色，浆液性。②比重<1.018。③不自凝。④白细胞计数常<0.1×10⁹/L。⑤细菌性检测阴性，无病原菌（E对）。渗出液为炎性积液，其特点为：①外观不定，可为血性（A错）、脓性、乳糜性等。②比重>1.018（B错）。③能自凝（C错）。④白细胞计数常>0.5×10⁹/L。⑤细菌学检测可找到病原菌。